牙龈纤维瘤病病因介绍最全面的是
A. 病因至今不明
B. 患者有家族史
C. 患者无家族史
D. 常染色体显性遗传
E. 常染色体隐性遗传

正确答案：A。病因至今不明

解析：牙龈纤维瘤病病因至今不明，有的患者有家族史，但也有的患者并无家族史。有家族史者可能为常染色体显性或隐性遗传。掌握“牙龈纤维瘤病”知识点。